腹水患者，可以叩出移动性浊音，则说明其量约为
A. 500～600ml
B. 700～800ml
C. 800～900ml
D. 900～1000ml
E. ＞1000ml

正确答案：E。＞1000ml

解析：腹水患者，当腹腔内游离腹水＞1000ml（E对）时，可以叩出移动性浊音。